以“心脾同治，重在补脾”为配伍特点的方剂是
A. 四物汤
B. 归脾汤
C. 炙甘草汤
D. 补中益气汤
E. 当归补血汤

正确答案：B。归脾汤

解析：归脾汤中以参、芪、术、草大队甘温之品补脾益气以生血，使气旺而血生；当归、龙眼肉甘温补血养心，茯苓（多用茯神）、酸枣仁、 远志宁心安神；木香辛香而散，理气醒脾，姜、枣调和脾胃，以资化源。故为心脾同治，重在补脾（B对）。四物汤是以“补血而不滞血，行血而不伤血”为配伍特点（A错）。炙甘草汤滋而不腻，温而不燥，使气血充足，阴阳调和，则心动悸、脉结代，皆得其平（C错）。补中益气汤使气虚得补，气陷得升（D错）。当归补血汤补气生血（E错）。